囊性纤维化患儿感染铜绿假单胞菌应选用
A. 古霉素
B. 环丙沙星
C. 莫西沙星
D. 氟喹诺酮类
E. 左氧氟沙星

正确答案：B。环丙沙星

解析：氟喹诺酮类对脑膜炎奈瑟菌具有强大的杀菌作用，其在鼻咽分泌物中浓度高，可用于鼻咽部带菌者的根除治疗。对其他抗菌药物无效的儿童重症感染可选用氟喹诺酮类；囊性纤维化患儿感染铜绿假单胞菌时，应选用环丙沙星。掌握“喹诺酮类”知识点。